治疗肺炎喘嗽痰热闭肺证,应首选
A. 三拗汤
B. 五虎汤合葶苈大枣泻肺汤
C. 二陈汤
D. 定喘汤
E. 麻杏石甘汤

正确答案：B。五虎汤合葶苈大枣泻肺汤

解析：该题主要考查治疗肺炎喘嗽各证型的方药。痰热闭肺是肺炎喘嗽的常证：证候 发热烦躁，咳嗽喘促，呼吸困难，气急鼻煽，喉间痰鸣，口唇紫苷，面赤口渴，胸闷胀满，泛吐痰涎，舌质红，舌苔黄，脉象弦滑。治法清热涤痰，开肺定喘，方药五虎汤合葶苈大枣泻肺汤加减（B对）。三拗汤治疗肺炎喘嗽毒热闭肺（A错）。二陈汤治疗痰湿咳嗽（C错）。定喘汤治疗风热外束，痰热内蕴之哮喘症（D错）。麻杏石甘汤治疗肺炎喘嗽风热闭肺（E错）。